在人体脏器中，能够产生血小板抗体的主要部位是
A. 肝脏
B. 脾脏
C. 心脏
D. 肾脏
E. 胆囊

正确答案：B。脾脏

解析：脾脏是血小板抗体产生的主要部位。掌握“特发性血小板减少性紫癜（ITP）”知识点。